乳化剂属于热力学不稳定的非均相分散系统，制成后，放置过程中容易出现分层、絮凝等不稳定现象，若出现的分层现象经振摇后能恢复原状，其原因是
A. 分散相乳滴ξ（Zeta）电位降低
B. 分散相与连续相存在密度差
C. 乳化剂类型改变
D. 乳化剂失去乳化作用
E. 微生物的作用

正确答案：B。分散相与连续相存在密度差

解析：本题考查乳剂。乳剂属于热力学不稳定的非均相分散体系。乳剂的分层系指乳剂放置后出现分散相粒子上浮或下沉的现象，又称乳析。分层主要是由于分散相和分散介质之间的密度差（B对）造成的。分层的乳剂经振摇后仍能恢复成均匀的乳剂。分散相乳滴ξ（Zeta）电位降低（A错）是引起乳剂絮凝的原因。乳化剂类型改变（C错）是引起乳剂转相的原因。乳化剂失去乳化作用（D错）是引起乳剂破裂的原因。微生物的作用（E错）是引起乳剂酸败的原因。